阻塞性黄疸病人不应表现为
A. 胆总管结石伴有发热
B. 胰头癌伴有胆囊肿大
C. 血中结合胆红素显著升高
D. 胆总管结石黄疸呈波动性
E. 尿中胆红素阴性

正确答案：E。尿中胆红素阴性

解析：梗阻性黄疸时，经肾小球滤过的结合胆红素增加，尿中的结合胆红素增加，尿中胆红素阳性（E错，为本题正确答案）。当胆总管结石合并感染时，可伴有发热（A对）。胰头癌压迫或浸润胆总管，可以引起梗阻性黄疸，并伴有胆囊肿大（B对）。梗阻性黄疸时，胆汁排泄障碍，使血中胆红素显著升高（C对）。胆总管结石可引起胆总管下端梗阻，使胆汁排出障碍，引起梗阻性黄疸，由于胆结石在胆总管内可上下浮动，所以黄疸也呈现波动性（D对）。